女，30岁。寒颤、发热、腰痛伴尿频、尿急3天。体温39℃，心肺无异常，肝脾肋下未触及，两侧肋脊角有叩击痛。尿液检查：蛋白（-），镜检红细胞2～5／HP、白细胞10～15／HP，诊断应首先考虑
A. 急性膀胱炎
B. 急性肾盂肾炎
C. 急性肾小球肾炎
D. 肾结核
E. 肾结石

正确答案：B。急性肾盂肾炎

解析：青年女性患者（急性肾盂肾炎女性发病率高于男性，在新婚期、妊娠期更易发生），寒颤、发热、腰痛伴尿频、尿急3天，两侧肋脊角有叩击痛（急性肾盂肾炎患者典型的临床表现），镜检红细胞2～5／HP（正常值为0～3／HP）、白细胞10～15／HP（正常值为0～5／HP），考虑诊断为急性肾盂肾炎（B对）。急性膀胱炎（P537）（A错）常表现为突发的尿频、尿急、尿痛等症状，而较少出现高热等明显的全身症状。急性肾小球肾炎（C错）表现为以血尿、蛋白尿、水肿、高血压为特征的肾炎综合征。肾结核（P544）（D错）的典型特点为病变在肾而症状在膀胱，一般无腰痛，常有低热、消瘦等表现。肾结石（P558）（E错）可引起肾绞痛，典型表现为阵发性腰部或上腹部疼痛，剧烈难忍，并沿输尿管行径放射至同侧腹股沟，还可涉及同侧睾丸或阴唇。